下列哪项不是影响全冠固位的因素
A. 牙冠高度
B. 牙冠周径
C. 所用合金种类
D. 缺损情况
E. （牙合）力

正确答案：C。所用合金种类

解析：本题考查影响全冠固位的因素。所用合金种类（C错，为本题的正确答案）与全冠的抗力有关，但不影响固位。牙冠高度（A对）越大，即（牙合）龈高度越大，固位力越强。牙冠周径（B对）越大，即横截面直径越大，旋转脱位的旋转半径越大，约束固位力越小。基牙的缺损情况（D对）会影响牙冠的高度、周径、剩余牙体组织的量，继而影响固位。牙齿所受（牙合）力（E对）也会影响全冠固位，若（牙合）力过大，则不利于固位，需要设计辅助固位形以增加全冠固位，发挥其功能。